医学人道主义的根本思想
A. 尊重患者的生命
B. 尊重患者的人格与尊严
C. 尊重患者平等的医疗与健康权利
D. 注重对社会利益及人类健康利益的维护
E. 患者的法律地位

正确答案：A。尊重患者的生命

解析：医学人道主义的核心内容：尊重患者生命、尊重患者的人格与尊严、尊重患者平等的医疗与健康权利、注重对社会利益及人类健康利益的维护、社会及患者对医院、医务人员利益和价值的尊重，其中尊重患者生命为医学人道主义的根本思想（A对BCD错）。患者的法律地位不属于医学人道主义的内容（E错）。